有关HDV的特性下述哪项不正确
A. HDV是缺损病毒
B. HDV外包HBsAg
C. HDV无核衣壳
D. HDV基因序列变异小
E. HDV只有一个血清型

正确答案：D。HDV基因序列变异小

解析：本题考查HDV的特性。HDV是缺损病毒（A对），必须外包HBsAg（B对）或其他嗜肝病毒才能复制，HDV无核衣壳（C对）。HDV有三个基因型，但HDV只有一个血清型（E对），HDV的不同基因型不仅有地区分布差异，可能也存在致病性的差异，因此HDV基因序列变异较大（D错，为本题正确答案）。